判断多尿是否为尿崩症的试验
A. 禁水（禁饮）试验
B. 测定尿渗透压和血钠
C. 测定尿渗透压和比重
D. 测定血浆和尿渗透压
E. 垂体后叶素试验

正确答案：A。禁水（禁饮）试验

解析：正常成人禁水后尿量明显减少，尿渗透压超过800mOsm/（kg·H₂O）。尿崩症病人禁水后尿量仍多，尿渗透压常不超过血浆渗透压（A对）。